某女，29岁。因全身浮肿就诊，经系统检查，诊为肾病综合征，中医诊断为肾阳亏虚型水肿，采用中西药综合治疗。结合病情，既符合中医辨证，又能增加西药利尿效果的方剂是
A. 六味地黄汤
B. 五苓散
C. 真武汤
D. 参苓白术散
E. 越婢加半夏汤

正确答案：C。真武汤

解析：本题考查的是中西药合理联用的例举。结合病情，既符合中医辨证，又能增加西药利尿效果的方剂是真武汤（C对）。木防己汤、真武汤、越婢加术汤、分消汤等与西药利尿药联用，可以增强利尿效果。清肺汤、竹叶石膏汤、竹茹温胆汤、六味地黄丸（A错）等与抗生素类药联用，有增强抗生素治疗呼吸系统反复感染效果的作用。参苓白术散（D错）中含人参，黄芪、人参、女贞子、刺五加、当归、山茱萸等，与西药化疗药联用，可降低患者因化疗药而导致的白细胞降低等不良反应。越婢加半夏汤（E错）中含麻黄，麻黄与青霉素联用，治疗细菌性肺炎，有协同增效作用；用含麻黄类中药治疗哮喘，常因含麻黄素而导致中枢神经兴奋，若与巴比妥类西药联用，可减轻此副作用；含甘草，甘草与氢化可的松在抗炎抗变态反应时同用，有协同作用；黄精、骨碎补、甘草等与链霉素联用，能消除或减少链霉素引发的耳鸣、耳聋等不良反应。五苓散（B错）与西药的联用，2022年考试指南未明确说明。